将一份问卷对同一个调查对象的反复测量，是在检验问卷
A. 效度
B. 信度
C. 可行性
D. 真实性
E. 是否有逻辑错误

正确答案：B。信度